当交感神经兴奋时，会表现为
A. 支气管平滑肌收缩
B. 冠状动脉收缩
C. 瞳孔缩小
D. 心跳减慢，血压降低
E. 胃肠蠕动减弱

正确答案：E。胃肠蠕动减弱

解析：当交感神经兴奋时，神经末梢释放神经递质导致出现心跳加快、血压升高、支气管扩张、瞳孔开大、消化活动受抑制（E对）等现象。